下列属于化瘀止血药的是
A. 蒲黄、茜草
B. 地榆、降香
C. 大蓟、小蓟
D. 槐花、三七
E. 侧柏叶、白茅根

正确答案：A。蒲黄、茜草

解析：三七、茜草、蒲黄、花蕊石均属于化瘀止血药（A对）。地榆是凉血止血药，可凉血止血，解毒敛疮。降香是活血止痛药，可化瘀止血，理气止痛（B错）。大蓟、小蓟均属于凉血止血药，可凉血止血，散瘀解毒消痈（C错）。槐花是凉血止血药，可凉血止血，清肝泻火。三七是化瘀止血药，可散瘀止血，消肿定痛（D错）。侧柏叶、白茅根是凉血止血药，侧柏叶可凉血止血，化痰止咳，生发乌发。白茅根可凉血止血，清热利尿（E错）。